男性患儿，5岁。咳嗽2日，呈阵发性痉咳伴鸡鸣样回声，应考虑的是
A. 急性喉炎
B. 急性肺炎
C. 百日咳
D. 肺结核
E. 麻疹

正确答案：C。百日咳

解析：本例患者为5岁幼儿，对百日咳杆菌易感性最强，且出现百日咳的典型症状：咳嗽，呈阵发性痉咳伴鸡鸣样回声，应首先考虑的诊断为百日咳（C对）。急性喉炎（A错）临床主要表现为声音嘶哑、喉部不适、干燥、烧灼感、异物感，喉部及气管前可有轻微疼痛，发声时喉痛加重、咳嗽、呼吸困难等。急性肺炎（B错）是小儿时期常见的疾病，临床主要表现为发热、咳嗽可伴有呕吐、呛奶，呼吸表浅增快，鼻煽，部分患儿口周、指甲轻度发绀，除呼吸道症状外，患儿可伴有精神萎靡，烦躁不安，食欲不振，哆嗦，腹泻等全身症状。肺结核（D错）临床多呈慢性过程，表现为长期低热、咳嗽、咳痰、咯血等。麻疹（E错）是由麻疹病毒引起的一种急性呼吸道传染病，以发热、咳嗽、流涕、眼结膜充血、口腔麻疹黏膜斑及皮肤斑丘疹为临床特征。